纤维囊壁内出现腺体的是
A. 含牙囊肿
B. 牙源性角化囊肿
C. 鳃裂囊肿
D. 根尖周囊肿
E. 甲状腺舌管囊肿

正确答案：E。甲状腺舌管囊肿

解析：本题考查甲状腺舌管囊肿。纤维囊壁内出现腺体的是甲状腺舌管囊肿（E对）。1.甲状舌管囊肿是甲状舌导管残余上皮发生的囊肿。其囊内容物为清亮黏液样物质。囊壁可内衬假复层纤毛柱状上皮或复层鳞状上皮，常见两者的过渡形态，邻近口腔处的囊肿衬里多为复层鳞状上皮，而位置靠下方者多为纤毛柱状上皮衬里。纤维性囊壁内偶见甲状腺或黏液腺组织。2.含牙囊肿（A错）又称滤泡囊肿，是指囊壁包含一个未萌牙的牙冠并附着于该牙的牙颈部的囊肿。含牙囊肿纤维囊壁中有时可见牙源性上皮岛。3.牙源性角化囊肿（B错）的纤维组织囊壁内有时可见微小的子囊和/或上皮岛。4.鳃裂囊肿（C错）的纤维囊壁内含有大量淋巴样组织并形成淋巴滤泡。5.根尖周囊肿（D错）的纤维组织囊壁内炎症明显，炎性浸润细胞主要为淋巴细胞、浆细胞，也混杂有中性粒细胞浸润以及泡沫状吞噬细胞。